根据过去某时点的特征或暴露情况将研究对象分为不同组别，然后从那时开始依据已有的记录，追溯到研究当时为止的一段时间内每个成员发病或死亡的情况，以评价暴露与疾病的关系，这种方法是
A. 生态学研究
B. 病例对照研究
C. 队列研究
D. 历史性队列研究
E. 筛查

正确答案：D。历史性队列研究

解析：本题考查历史性队列研究的概念。历史性队列研究（D对ABCE错）是指根据过去某时点的特征或暴露情况将研究对象分为不同组别，然后从那时开始依据已有的记录，追溯到研究当时为止的一段时间内每个成员发病或死亡的情况，以评价暴露与疾病的关系的一种研究方法。